分子空穴直径最大的环糊精是
A. α-CYD
B. β-CYD
C. γ-CYD
D. HP-CYD
E. 乙基-CYD

正确答案：C。γ-CYD

解析：本题考查环糊精的特点。分子空穴直径最大的环糊精是γ-CYD（C对）。